添加粥、烂面、碎菜等末状食物应在
A. 10～12个月
B. 1～3个月
C. 4～6个月
D. 7～9个月
E. 12～15个月

正确答案：D。7～9个月

解析：7～9个月：末状食物，如粥、烂面、碎菜、蛋、鱼、肝泥、肉末、豆腐、饼干、馒头片、面包片、熟土豆、芋头等。掌握“婴儿喂养方法”知识点。